不支持流行性脑脊髓膜炎诊断的脑脊液检查是
A. 外观混浊呈脓性
B. 蛋白质含量高
C. 细胞数<0.5×l0⁶/L，以单核细胞为主
D. 糖定量明显减少
E. 氯化物含量减少

正确答案：C。细胞数<0.5×l0⁶/L，以单核细胞为主

解析：流脑脑脊液检查，典型脑膜炎期，压力高达200mmH₂O，外观混浊呈米汤或脓样（A对），白细胞计数显著升高，可达1000×l0⁶/L以上，以中性粒细胞为主（C错，为本题正确答案），蛋白质含量高（B对），而糖定量明显减少（D对），有时可完全测不出，氯化物含量减少（E对）。